属于器官非特异性自身免疫性疾病的是
A. 重症肌无力
B. 类风湿性关节炎
C. Ⅰ型糖尿病
D. 甲亢(Graves病)
E. 桥本病(慢性甲状腺炎)

正确答案：B。类风湿性关节炎

解析：器官非特异性自身免疫性疾病又称全身性或系统性自身免疫性疾病，病变可见于多种器官，结缔组织多受累，故又称结缔组织病。典型疾病有系统性红斑狼疮（SLE）和类风湿关节炎等。掌握“自身免疫概述以及临床常见自身免疫性疾病”知识点。